问卷调查时，从问题测量的内容上，可将问题分为
A. 事实问题，行为问题，态度问题
B. 特征问题，事实问题，主观问题
C. 特征问题，方法问题，态度问题
D. 特征问题，行为问题，态度问题
E. 主观问题，客观问题，态度问题

正确答案：D。特征问题，行为问题，态度问题

解析：本题考查问题的分类。问卷调查时，从问题测量的内容上，可以将问题分为特征问题、行为问题和态度问题（D对ABCE错）3类。